补体不具备的作用是
A. 抗细菌作用
B. 调理作用
C. 免疫黏附作用
D. 中和毒素的作用
E. 炎症介质作用

正确答案：D。中和毒素的作用